副交感神经兴奋可引起
A. 瞳孔扩大
B. 糖原分解
C. 胃肠运动增强
D. 骨骼肌血管舒张
E. 竖毛肌

正确答案：C。胃肠运动增强

解析：副交感神经兴奋时释放乙酰胆碱（ACh）与胃肠平滑肌M受体结合使胃肠运动增强（C对），与虹膜环形肌M受体结合虹膜环形肌收缩，瞳孔缩小（A错）。支配糖原分解增加（Ｂ错）、骨骼肌血管舒张（D错）的神经纤维均为交感神经。竖毛肌（E错）只受交感神经支配。